哪项符合典型溶血型黄疸的尿三胆改变
A. 尿胆原（﹢﹢），尿胆素（﹢﹢），尿胆红素（﹣）
B. 尿胆原（﹢），尿胆素（﹢），尿胆红素（﹢）
C. 尿胆原（﹣），尿胆素（﹣），尿胆红素（﹢﹢）
D. 尿胆原（﹣），尿胆素（﹣），尿胆红素（﹣）
E. 尿胆原（﹢），尿胆素（﹣），尿胆红素（﹢）

正确答案：A。尿胆原（﹢﹢），尿胆素（﹢﹢），尿胆红素（﹣）